下列关于小儿五软概念的叙述，错误的是
A. 头项软
B. 肌肉软
C. 腰膝软
D. 手软
E. 脚软

正确答案：C。腰膝软

解析：五迟、五软是小儿生长发育障碍的病症，多由于先天禀赋不足、后天调护失当引起，肾主骨，肝主筋，脾主肌肉，若肝、肾、脾不足，则筋骨肌肉失养，不可见腰膝酸软（C错，为本题正确答案）。可见头项软而无力，不能抬举（A对）。肌肉软而无力（B对）。手软无力而下垂，不能握举（C对）。足软无力，难于行走（E对）。